男，56岁。尿中泡沫增多2年，间断双下肢水肿，晨轻暮重半年。既往患2型糖尿病15年，目前使用二甲双胍(1.5g/日）联合预混胰岛素30R(早、晚餐前皮下注射）治疗。冠心病病史10年，2年前行PTCA治疗。查体：BP155/85mmHg，腹型肥胖，心肺无显著异常，双下肢轻度凹陷性水肿。尿蛋白(++）。患者24小时尿蛋白定量2.3g，eGPR70ml/min，HbAc7.0%。下一步降糖治疗最恰当的是
A. 停用二甲双胍，改用阿卡波糖联合胰岛素治疗
B. 停用二甲双胍，单独使用胰岛素治疗
C. 停用二甲双胍，改用瑞格列奈联合胰岛素治疗
D. 增加二甲双胍剂量，胰岛素维持原剂量
E. 停用二甲双胍，改用α-葡萄糖苷酶抑制剂联合胰岛素治疗

正确答案：B。停用二甲双胍，单独使用胰岛素治疗

解析：中年男性患者，临床诊断为2型糖尿病，尿中泡沫增多2年，间断双下肢水肿，综合患者的症状、体征和辅助检查，初步诊断为2型糖尿病合并肾功能不全。二甲双胍禁用于肾功能不全患者，胰岛素适用于各种严重的糖尿病急性或慢性并发症，下一步降糖治疗最恰当的是停用二甲双胍（D错），单独使用胰岛素治疗（B对）。阿卡波糖（A错）是α-葡萄糖苷酶抑制剂（AGI）（E错），主要用于肥胖型餐后高血糖患者。瑞格列奈（C错）是格列奈类药物，主要用于非肥胖型餐后高血糖患者。